性味甘、辛、温的药是
A. 当归
B. 熟地黄
C. 何首乌
D. 白芍
E. 阿胶

正确答案：A。当归

解析：本题考查的是当归的性味归经。性味甘、辛、温的药是当归（A对）。当归：【性味归经】甘、辛，温。归肝、心、脾经。熟地黄（B错）：【性味归经】甘，微温。归肝、肾经。何首乌（C错）：【性味归经】苦、甘、涩，微温。归肝、肾经。白芍（D错）：【性味归经】酸、甘、苦，微寒。归肝、脾经。阿胶（E错）：【性味归经】甘，平。归肺、肝、肾经。